属于β受体激动药的是
A. 新斯的明
B. 异丙肾上腺素
C. 可乐定
D. 阿托品
E. 酚妥拉明

正确答案：B。异丙肾上腺素

解析：本题考查β受体激动药。异丙肾上腺素（B对）对α受体几乎无作用，对β₁、β₂受体均有强大激动作用。新斯的明（A错）是可逆性抗胆碱酯酶药。可乐定（C错）是中枢性α₂肾上腺素受体受体激动药。阿托品（D错）为M胆碱受体阻断药。酚妥拉明（E错）为α₁、α₂受体拮抗药。